精神障碍患者杜某有危害他人安全的行为的危险情形，但其监护人对医疗机构作出需要住院治疗的诊疗结论有异议，不同意对患者实施住院治疗，并在收到诊断结论之日起规定期限内向其他具有合法资质的医疗机构提出了再次诊断的要求。该期限是
A. 3日
B. 7日
C. 10日
D. 15日
E. 30日

正确答案：A。3日